Ⅱ型呼吸衰竭是指
A. PaO₂﹤50mmHg，PaCO₂﹥60mmHg
B. PaO₂﹥60mmHg，PaCO₂﹤50mmHg
C. PaO₂﹤60mmHg，PaCO₂﹥50mmHg
D. PaO₂﹤55mmHg，PaCO₂﹥50mmHg
E. PaO₂﹤60mmHg，PaCO₂﹤50mmHg

正确答案：C。PaO₂﹤60mmHg，PaCO₂﹥50mmHg